有关无偿献血制度说法正确的是
A. 国家鼓励提倡老年人献血
B. 献血不需保证临床用血需要和安全
C. 无偿献血的血液必要时也可进行买卖
D. 医疗机构不得将无偿献血血液出售给单采血浆站
E. 国家提倡18周岁至45周岁的健康公民自愿献血

正确答案：D。医疗机构不得将无偿献血血液出售给单采血浆站

解析：《献血法》国家实行无偿献血制度。国家提倡18周岁至55周岁的健康公民自愿献血。献血应当保证临床用血需要和安全，保障献血者和用血者身体健康。国家机关、军队、社会团体、企业事业组织、居民委员会、村民委员会，应当动员和组织本单位或者本居住区的适龄公民参加献血。国家鼓励国家工作人员、现役军人和高等学校在校学生率先献血，为树立社会新风尚作表率。无偿献血的血液必须用于临床，不得买卖。血站、医疗机构不得将无偿献血的血液出售给单采血浆站或者血液制品生产单位。掌握“无偿献血、医疗机构和血站职责及法律责任”知识点。